KenndyIV的活动义齿模型设计时，将模型向后倾斜的主要目的
A. 使义齿由前向后戴入
B. 制作方便、便于义齿的摘戴
C. 利用倒凹固位
D. 牙槽嵴丰满，唇侧倒凹过大
E. 减少义齿前份基托与余留牙间的间隙、利于美观

正确答案：E。减少义齿前份基托与余留牙间的间隙、利于美观

解析：若前牙缺失，牙槽嵴丰满，唇侧有较大的倒凹时，应将模型向后倾斜，以减少牙槽嵴的唇侧倒凹。义齿则由前向后斜向就位，使余留前牙与人工牙之间的间隙减小，有利于美观。若唇侧组织倒凹不大，不影响义齿就位。模型的倾斜取决于基牙及余留牙倒凹区的大小，一般是将模型向前倾斜，使倒凹集中在基牙的近中侧，固位较好，义齿侧由后向前倾斜就位。掌握“局部义齿的设计”知识点。